女性患者，50岁，双下肢水肿10余年，晨轻暮重，无眼睑水肿和泡沫尿。查体：BP130/70mmHg，双肺呼吸音清，心界不大，心率87次/分，律齐。腹软，肝脾肋下未触及，移动性浊音阴性，双下肢见凹陷性水肿，浅静脉呈蚯蚓状改变。该患者下肢水肿的最可能原因是
A. 下肢静脉压增高
B. 血浆胶体渗透压降低
C. 心肌收缩力降低
D. 血浆晶体渗透压降低
E. 淋巴液回流受阻

正确答案：A。下肢静脉压增高

解析：该患者下肢水肿的最可能原因是下肢静脉压增高（A对）。小腿部静脉管径较小，管壁较薄，当静脉内压增高时可导致静脉迂曲扩张，呈蚯蚓状改变。血浆胶体渗透压降低（B错）引起的下肢水肿多见于肾病综合征，常伴眼睑水肿及腹水，因尿中蛋白质含量过高可出现泡沫尿。心肌收缩力降低（C错）引起的下肢水肿多见于右心衰，常表现为颈静脉怒张，心率增快，可出现心率失常；肝脏肿大且有压痛，严重者可出现腹水。淋巴液回流受阻（E错）引起的水肿常伴有患肢增粗、皮肤增厚、粗糙。血浆晶体渗透压降低（D错）一般不引起水肿。